下列治疗消化性溃疡的药物中，抑酸最强疗效最佳的是
A. 西咪替丁
B. 阿托品
C. 硫糖铝
D. 奥美拉唑
E. 胶体次枸椽酸铋

正确答案：D。奥美拉唑

解析：奥美拉唑（D对）为质子泵抑制剂（PPI），抑酸作用很强，可使胃内达到无酸水平，并且抑酸时间长，可达72小时，是治疗消化性溃疡的药物中，抑酸最强疗效最佳的药物。西咪替丁（A错）是H₂受体拮抗剂，抑酸效果稍差于奥美拉唑等质子泵抑制剂。阿托品（B错）是阻断M受体的抗胆碱药，对治疗消化性溃疡无效。硫糖铝（C错）和胶体次枸橼酸铋（E错）是胃黏膜保护剂（P362），无抑酸作用。